关于白斑的临床分型下列哪项说法是错误的
A. 分为均质型和非均质型
B. 非均质型又分为疣状型、颗粒型和溃疡型
C. 均质型表现为均质斑块或表面有皱褶
D. 疣状型属于非均质型
E. 非均质型包括疣状型、颗粒型和萎缩型

正确答案：E。非均质型包括疣状型、颗粒型和萎缩型

解析：本题考查白斑的临床分型。白斑的临床分型错误的是非均质型包括疣状型、颗粒型和萎缩型（E错，为本题的正确答案）。白斑分为均质型和非均质型（A对），均质型表现为斑块或表面皱褶（皱纹纸状）（C对），非均质型表现为疣状（疣状型）、颗粒状（颗粒型）和溃疡状（溃疡型）（BD对），但不包括萎缩型。